已婚妇女，29岁。妊娠20周，一日前出现少量阴道流血，继而出现阵发下腹痛；妇科检査宫口未开，胎膜未破。一日来阴道流血量增多，腹痛加剧，妇科检查宫颈口已张开。此时正确诊断为
A. 先兆流产
B. 难免流产
C. 不完全流产
D. 完全流产
E. 功能失调性子宫出血

正确答案：B。难免流产

解析：该孕妇妊娠20周（流产为妊娠＜28周、胎儿体重＜1000g而终止者），一日前出现少量阴道流血，继而出现阵发下腹痛（先兆流产主要为停经后阴道流血和腹痛），妇科检査宫口未开，胎膜未破（先兆流产妇科检查宫口未开，胎膜未破）。一日来阴道流血量增多，腹痛加剧（难免流产在先兆流产基础上，阴道流血量增多，阵发性下腹痛加剧），宫颈口已张开（难免流产时妇科检查宫颈口已扩张，流产不可避免），提示先兆流产发展为难免流产（B对A错）。不完全流产（P49）（C错）是难免流产的继续发展，部分妊娠物排出宫腔，部分残留于宫腔内或嵌顿于宫颈口，影响子宫收缩，导致大量出血，甚至休克，妇科检查宫口开大，子宫小于停经周数。完全流产（P49）（D错）指妊娠物已全部排出，阴道流血逐渐停止，腹痛逐渐消失，妇科检查宫颈口已关闭，子宫接近正常大小。功能失调性子宫出血（P345）（E错）最常见的症状是子宫不规则出血，表现为月经周期紊乱，经期长短不一，经量不定或增多，甚至大量出血。